某女，45岁。素患血虚萎黄、月经不调，近日又见手足麻木。宜选用的中药是
A. 苏木
B. 干漆
C. 月季花
D. 鸡血藤
E. 王不留行

正确答案：D。鸡血藤

解析：本题考查鸡血藤的主治病证。宜选用的中药是鸡血藤（D对）。鸡血藤【主治病证】（1）月经不调，痛经，闭经，跌打损伤。（2）血虚萎黄。（3）手足麻木，肢体瘫痪，风湿痹痛。苏木（A错）【主治病证】（1）血滞闭经、痛经，产后瘀阻腹痛，胸腹刺痛。（2）跌打损伤，瘀滞肿痛。干漆（B错）【主治病证】（1）闭经，癥瘕积聚。（2）虫积腹痛。月季花（C错）【主治病证】（1）月经不调，痛经，闭经。（2）肝郁之胸胁胀痛。王不留行（E错）【主治病证】（1）血瘀痛经、闭经，难产。（2）乳汁不下，乳痈肿痛。（3）淋证涩痛，小便不利。